女，25岁。妊娠37周，G₁P₀，因羊膜破裂入院待产。既往身体健康，无传染病及遗传性疾病史。分娩过程顺利，产一男婴7斤重。分娩后突然出现呼吸困难、发绀、抽搐、休克、死亡。最可能发生的是
A. 血栓形成
B. 空气栓塞
C. 脂肪栓塞
D. 心肌梗死
E. 羊水栓塞

正确答案：E。羊水栓塞

解析：青年女性患者，既往无疾病史，妊娠37周，因羊膜破裂入院，且在分娩后出现呼吸困难、发绀、抽搐、休克等症状，并最终导致死亡，最应考虑羊水检塞（E对）的可能性。因患者羊膜破裂，且分娩时子宫强烈收缩导致宫内压增高，故羊水可压入子宫壁破裂的静脉窦内，随血液循环到达全身各个器官，引起羊水栓塞。血栓形成（A错）为慢性过程，不会突发全身症状并死亡。空气栓塞（B错）多见于头颈、胸壁和肺部手术或创伤损伤静脉时。脂肪栓塞（C错）多见于长骨骨折、脂肪挫伤及烧伤时。患者既往身体健康，无冠心病病史，故不会发生心肌梗死（D错）。